常引起角膜结膜炎的病原体是
A. HSV-1
B. HSV-2
C. VZV
D. CMV
E. EBV

正确答案：A。HSV-1